下列关于“实”的病机概念的叙述，错误的是
A. 外感邪盛
B. 肌肤经络闭塞
C. 气机升降失调
D. 脏腑功能亢进
E. 气血壅滞瘀结

正确答案：C。气机升降失调

解析：气机升降失调（C错，为本题正确答案）常表现为气陷证、气不固证、气脱证、气滞证、气逆证、气闭证。其中气陷证、气不固证、气脱证以虚证为主，气滞证、气逆证、气闭证多以实证为主。外感邪气（A对），侵入人体，邪盛正不虚，机体正气奋起抗邪，表现为实证。风寒湿邪侵入肌肤经络，使肌肤经络闭塞不通（B对），发为实证。脏腑功能亢进（D对），气化失司，气机阻滞，形成痰、饮、水、湿、脓、瘀血等有形病理产物，壅滞停积于内形成实证。气血壅滞瘀结（E对）局部阻滞不通，发为有形实邪。